阳损及阴的病机是指
A. 阳气虚损，气化不利，水湿阴寒，病邪积聚
B. 阳气偏盛，消灼阴液，阴液亏损
C. 阳热内盛，深伏于里，格阴于外
D. 阳气虚损，阴气失制而偏盛
E. 阳气虚损，累及阴液化生不足

正确答案：E。阳气虚损，累及阴液化生不足

解析：阳损及阴，系指由于阳气虚损，无阳则阴无以生，从而在阳虚的基础上又导致了阴虚，形成以阳虚为主的阴阳两虚病理状态（E对）。阳气虚损，气化不利，水湿阴寒，病邪积聚是阳虚的病机（A错）。阳气偏盛，消灼阴液，阴液亏损是阳偏盛的病机，实质是阳偏盛而阴未衰（B错）。阳热内盛，深伏于里，格阴于外是阳盛格阴的病机，实质是真热假寒（C错）。阳气虚损，阴气失制而偏盛是阳虚阴盛的病机，实质是阳气不足，阳不制阴（D错）。